心肌梗死24小时内并发急性左心衰竭时，最不宜应用
A. 吗啡
B. 洋地黄
C. 利尿剂
D. 硝酸甘油
E. 多巴酚丁胺

正确答案：B。洋地黄

解析：心肌梗死引起的心力衰竭早期主要是坏死心肌间质充血、水肿引起顺应性下降所致，而左心室舒张末期容量尚不增大，此时用洋地黄既可加重心肌缺氧，也可导致心律失常，心肌梗死24小时内并发急性左心衰竭时，最不宜应用洋地黄（B错，为本题正确答案）。吗啡（P175）（A对）可使患者镇静，也可舒张小血管而减轻心脏负荷。利尿剂（P175）（C对）多选用呋塞米，其还可扩张静脉，缓解肺水肿。硝酸甘油（P175）（D对）可扩张动脉和小静脉，降低心脏前后负荷。多巴酚丁胺（P175）（E对）可增加心肌收缩力和心输出量而有利于改善急性左心衰竭患者的病情。